属于成人中度烧伤的是
A. Ⅲ度烧伤面积小于10%
B. 烧伤总面积达31%～50%
C. Ⅱ烧伤面积小于10%
D. Ⅱ烧伤面积小于20%伴休克
E. Ⅲ烧伤面积11%～20%

正确答案：A。Ⅲ度烧伤面积小于10%

解析：中度烧伤的定义是：Ⅱ°烧伤面积11%～30%，或有Ⅲ°烧伤但面积不足10%（A对）。烧伤总面积达31%～50%（B错）、Ⅱ°烧伤面积小于20%伴休克（D错）、Ⅲ°烧伤面积11%～20%（E错）属于重度烧伤。Ⅱ°烧伤面积小于10%（C错）属于轻度烧伤。